下列哪项不是伤寒的并发症
A. 肠出血
B. 肠穿孔
C. 胆囊炎
D. 中毒性肝炎
E. 胰腺炎

正确答案：E。胰腺炎

解析：伤寒不会并发胰腺炎（E错，为本题正确答案），其并发症主要包括肠出血（A对）、肠穿孔（B对）、中毒性肝炎（D对）、中毒性心肌炎、支气管炎和肺炎、溶血尿毒综合征，其他包括急性胆囊炎（C对）、血栓性静脉炎、骨髓炎、脑膜炎、肾盂肾炎偶尔发生，孕妇可发生早产或流产。